用非水溶液滴定法测定盐酸吗啡的含量，以下叙述中正确的有
A. 用中性乙醇作溶剂
B. 用冰醋酸作溶剂
C. 滴定前加入一定量醋酸汞试液
D. 用高氯酸滴定液滴定
E. 用结晶紫指示终点

正确答案：B、C、D、E。用冰醋酸作溶剂；滴定前加入一定量醋酸汞试液；用高氯酸滴定液滴定；用结晶紫指示终点